通过促进组织对葡萄糖摄取和利用发挥作用的药物是
A. 吡格列酮
B. 格列本脲
C. 二甲双胍
D. 阿卡波糖
E. 罗格列酮

正确答案：C。二甲双胍

解析：本题考查二甲双胍。二甲双胍（C对）通过促进组织对葡萄糖的摄取和利用，抑制葡萄糖在肠道的吸收，降低血糖。格列本脲（B错）能够促进胰岛素的释放，降低血清糖原水平。阿卡波糖（D错）为葡萄糖苷酶抑制剂。罗格列酮（E错）和吡格列酮（A错）为噻唑烷二酮类胰岛素增敏剂，其作用机制与特异性激活过氧化物酶增殖因子激活的γ型受体（PPAR-γ）有关，可提高组织对胰岛素的敏感性，提高组织摄取和利用葡萄糖从而降低血糖。